患者，女性，20岁。1型糖尿病患者，出现恶心、厌食2天，神志不清1小时，查体面色潮红，呼吸深快，意识障碍。诊断方面最可能是
A. 乳酸性酸中毒
B. 糖尿病酮症酸中毒
C. 糖尿病高渗性昏迷
D. 糖尿病合并尿毒症酸中毒
E. 低血糖昏迷

正确答案：B。糖尿病酮症酸中毒

解析：本题考查糖尿病酮症酸中毒。女性患者，20岁。1型糖尿病患者，出现恶心、厌食2天，神志不清1小时，查体面色潮红，呼吸深快，意识障碍，结合患者病史和临床表现，诊断方面最可能是糖尿病酮症酸中毒（B对）。乳酸性酸中毒（A错）可见于大量服用双胍类药物的糖尿病患者，是糖尿病的一种急性并发症。糖尿病高渗性昏迷（C错）常见于老年2型糖尿病患者，起病缓慢，最初表现为多饮、多尿，但多食不明显或反而食欲减退，逐渐出现严重脱水和神经精神症状，患者反应迟钝、烦躁或淡漠，逐渐陷入昏迷、抽搐，晚期尿少甚至尿闭，与糖尿病酮症酸中毒相比，失水更为严重，神经精神症状更为突出。糖尿病合并尿毒症酸中毒（D错）可见于病史较长的糖尿病患者，是导致终末期肾衰的常见病因，是1型糖尿病的主要死因。低血糖昏迷（E错）可见于1型糖尿病胡拿着胰岛素使用不当，，可表现为出汗、饥饿、感觉异常、流涎、颤抖、心悸、紧张、焦虑、软弱无力、面色苍白、心率加快、四肢冰凉及脑功能障碍表现，根据低血糖典型表现（Whipple三联征：1.低血糖症状；2.发作时血糖低于2.8mmol/L；3.供糖后低血糖症状迅速缓解）可以确诊。